可抑制细胞氧化磷酸化速率的物质是
A. 磷酸戊糖
B. 胰岛素
C. 细胞色素C
D. 一氧化碳
E. 磷酸激酶

正确答案：D。一氧化碳

解析：CO为电子传递抑制剂，与还原型Cyta3结合，阻断电子传递给O₂，从而抑制细胞氧化磷酸化的速率（D对）。